中国药典采用原子吸收分光光度法检查维生素C中的金属盐有
A. 铁盐
B. 铜盐
C. 汞盐
D. 砷盐
E. 锌盐

正确答案：A、B。铁盐；铜盐